在上颌尖牙腭侧相吻合的2条神经是
A. 上牙槽神经和腭中神经
B. 腭中神经与腭后神经
C. 鼻腭神经和腭中神经
D. 腭前神经与腭后神经
E. 腭前神经与鼻腭神经

正确答案：E。腭前神经与鼻腭神经

解析：本题考查在上颌尖牙腭侧相吻合的2条神经。翼腭神经发出4支，眶支、鼻支、腭神经及咽神经，腭神经分为前、中、后三支，腭前神经在上颌尖牙的腭侧黏骨膜内与鼻腭神经吻合（E对）。